麻黄碱具有
A. 发汗、平喘作用
B. 抗菌作用
C. 降血脂作用
D. 镇静、麻醉作用
E. 消肿利尿、抗肿瘤作用

正确答案：A。发汗、平喘作用

解析：本题考查麻黄的药理作用。麻黄碱具有发汗、平喘作用（A对）。麻黄的药理作用：（1）发汗：麻黄水煎剂、麻黄挥发油、麻黄碱使大鼠足跖部汗液分泌增多，其作用机制是通过影响下丘脑体温调节中枢，启动散热过程，兴奋外周a，受体，阻碍汗腺导管对钠离子的重吸收。（2）平喘、镇咳、祛痰：麻黄水煎液、麻黄醇提取物、麻黄生物碱、麻黄碱均具有平喘、镇咳作用。麻黄挥发油具有祛痰作用。（3）利尿（E错）：麻黄具有一定的利尿作用，且以D-伪麻黄碱的作用最明显。（4）解热、镇痛、抗炎：麻黄水煎液、麻黄挥发油具有显著的解热作用。麻黄挥发油和萜松醇对正常小鼠体温有降低作用。麻黄挥发油、麻黄水煎液对热刺激小鼠有显著镇痛作用。麻黄水提物、醇提物均有明显的抗炎作用，伪麻黄碱、甲基麻黄碱和麻黄碱是抗炎作用的主要有效成分。麻黄唑酮是麻黄中新分离出的具有抗炎活性的成分。决明子中主要蒽醌类成分的药理作用：决明子具有缓泻作用，也具有抗菌作用（B错），对金黄色葡萄球菌、白色葡萄球菌、白喉杆菌、伤寒杆菌等都有较好的抗菌作用。决明子还有降脂和抗动脉粥样硬化作用等。何首乌的药理作用：（1）促进造血功能：何首乌显著增加骨髓造血干细胞，提高粒-单系祖细胞产生率及骨髓红系祖细胞数量。（2）降血脂（C错）、抗动脉粥样硬化：何首乌可降低TC、TG水平，提高HDL/TC的比值。何首乌总苷能防止载脂蛋白E基因缺陷小鼠动脉粥样硬化病变的形成。（3）增强免疫功能：何首乌能增强巨噬细胞吞噬能力，提高NK细胞活性；提高老年大鼠外周淋巴细胞DNA的损伤修复能力，能促进小鼠T淋巴细胞、B淋巴细胞增殖。洋金花中生物碱的药理作用：莨菪碱及其外消旋体阿托品有解痉镇痛、解有机磷中毒和散瞳作用；东莨菪碱除具有莨菪碱的生理活性外，还有镇静、麻醉作用（D错）。